有关Cushing综合征（皮质醇增多症）的叙述哪项是错误的
A. 向心性肥胖，多毛，紫纹
B. 病程长者可肌肉萎缩，骨质疏松
C. 血中淋巴细胞及嗜酸性粒细胞增多
D. 葡萄糖耐量异常
E. 血压增高

正确答案：C。血中淋巴细胞及嗜酸性粒细胞增多